新生儿胎便的特点下列哪项是错误的
A. 新生儿生后12小时内排出胎便
B. 由肠黏膜脱落的上皮细胞，羊水及消化液组成
C. 墨绿色
D. 约2～3天排完
E. 早产儿胎便排出常延迟

正确答案：A。新生儿生后12小时内排出胎便

解析：新生儿胎便呈墨绿色（C对）糊状，由胎儿肠道分泌物、胆汁及咽下的羊水等组成（B对）。其中足月儿在生后24小时内（A错，为本题正确答案）排胎便，约2～3天排完（D对）；而早产儿由于胎粪形成较少及肠蠕动差，胎粪排出常延迟（E对）。